医院和医务人员在战争中对伤病员中立的是
A. 《纽伦堡法典》
B. 《道德与文明》
C. 希波克拉底誓言
D. 日内瓦宣言
E. 荷兰会议

正确答案：D。日内瓦宣言

解析：《日内瓦宣言》中提到：我将不容许有任何宗教，国籍，种族，政见或地位的考虑介于我的职责和病人间。《日内瓦宣言》（D对）看待病人平等，认为医院和医务人员在战争中对伤病员中立。